流行性出血热治疗原则以稳促导透的时期
A. 发热期
B. 低血压休克期
C. 少尿期
D. 多尿期
E. 恢复期

正确答案：C。少尿期

解析：流行性出血热的治疗原则以综合治疗为主，早期应用抗病毒治疗，中晚期则针对病理生理进行对症治疗，“三早一就”是本病治疗原则，及早发现，早期休息，早期治疗和就近治疗，治疗中要注意防止休克、肾衰竭和出血。发热期的治疗原则：抗病毒，减轻外渗，改善中毒症状和预防DIC（A错）。低血压休克期治疗原则：积极补充血容量，注意纠正酸中毒和改善微循环（B错）。少尿期治疗原则：稳、促、导、透，即稳定机体内环境，促进利尿、导泻和透析治疗（C对）。多尿期治疗原则：移行期和多尿早期的治疗同少尿期，多尿后期主要是维持水和电解质平衡，防治继发感染（D错）。恢复期治疗原则为：补充营养，逐步恢复工作，出院后应休息1～2个月，定期复查肾功能、血压和垂体功能，如有异常应及时治疗（E错）。